某心外科医生在实施一例先天性心脏病手术之前的晚上，在自己脑海中反复想象手术的过程、路径以及手术意外的应对措施等，这种思维方式是
A. 聚合思维
B. 形象思维
C. 发散思维
D. 抽象思维
E. 创造思维

正确答案：B。形象思维

解析：心外科医生在自己脑海中反复想象手术的过程、路径以及手术意外（具体形象过程）的应对措施，是形象思维（B对）。抽象思维（D错），是以抽象的概念和理论知识来解决问题的思维，这是人类思维的核心形式。聚合思维（A错）是把解决问题的各种信息聚合起来得出一个正确答案或最好的解决问题的方案。发散思维（C错）是指解决一个问题时，沿着不同的方向思考，找出多种答案、解决方法或结论。创造性思维（E错）是重新组织已有的知识经验，产生新颖的、前所未有的、有创造性想象参加的思维。